人体必需微量元素包括
A. 硫、铁、氯
B. 碘、镁、氟
C. 铁、铬、钴
D. 钙、锌、碘
E. 氯、铁、锌

正确答案：C。铁、铬、钴

解析：铁、铜、锌、硒、铬、碘、钴和钼被认为是必须微量元素。